患者25岁，男性，因右下后牙进食冷热食物痛1周，无自发痛，夜间痛史。检查：右下7颊面龋洞，探稍敏感，叩（-），松（-），牙龈（-），冷热测同对照牙。右下6颊面龋洞，探敏感，叩（-），松（-），牙龈（-），冷热测引起疼痛，去除后立即消失。其余牙未见异常，右下6颊面最可能的诊断为
A. 中龋
B. 深龋伴牙髓充血
C. 急性牙髓炎
D. 深龋
E. 慢性闭锁性牙髓炎

正确答案：B。深龋伴牙髓充血

解析：本题考查可复性牙髓炎。右下6颊面龋洞，探敏感，叩（-），松（-），牙龈（-），冷热测引起疼痛，去除后立即消失，根据该特点可诊断为可复性牙髓炎，牙髓充血是牙髓的病理状态，在临床诊断上称为可复性牙髓炎，该患者右下6可见龋洞，因此可得出由深龋造成的可复性牙髓炎（B对）。当龋病进展到牙本质时，对酸甜饮食敏感，对过冷过热饮食也产生酸痛感觉，尤其冷刺激尤为显著，刺激去除后症状立即消失，由于个体反应的差异，中龋有的患者可完全没有主观症状（A错）。急性牙髓炎的典型症状为剧烈疼痛，为自发性阵发性疼痛，疼痛不能定位，温度刺激可引发剧烈疼痛，夜间痛（C错）。深龋受到温度刺激时为刺激入洞时疼痛，患者冷热测已引起疼痛，已由深龋引起的可复性牙髓炎，而非单纯深龋（D错）。慢性闭锁性牙髓炎几乎所有患者都有长期的冷热刺激痛史，对温度刺激为敏感，也可为热测引起的迟缓性疼痛,探诊患牙感觉较为迟钝，去净腐质无肉眼可见穿髓孔，多有轻度叩痛或叩诊不适感（E错）。